GSP认证管理的初审部门完成初审后，应当将初审合格的GSP、认证申请书和资料移送
A. 省级药品监督管理部门审查
B. 省级药品监督管理部门药品认证中心审查
C. 国务院药品监督管理部门审查
D. 国务院药品监督管理部门药品认证中心审查
E. 设区的市级药品监督管理部门审查

正确答案：B。省级药品监督管理部门药品认证中心审查